外源性哮喘的临床表现是
A. 多见于青壮年
B. 常于冬季或气候骤变时发病
C. 前驱症状后发病急，缓解快
D. 有呼吸道感染症状
E. 起病慢，症状缓解后哮鸣音可持续多时

正确答案：C。前驱症状后发病急，缓解快

解析：外源性哮喘是患者对致敏原产生过敏的反应，致敏原包括尘埃、花粉、动物毛发、衣物纤维等。多见于儿童及青少年（A错），常于春秋发病（B错），可有前驱症状，发病急，缓解快（C对），缓解后哮鸣音很快消失（E错），血中IgE升高，无呼吸道感染症状（D错）。